关于甲基汞损害健康的正确论点是
A. 经食物摄入汞致汞中毒
B. 经饮水摄入汞致汞中毒
C. 汞经肠道吸收于血液
D. 甲基汞的碳-汞链不稳定
E. 进行性不可恢复性的病理损害

正确答案：E。进行性不可恢复性的病理损害

解析：本题考查甲基汞的相关内容。甲基汞主要经消化道摄入，具有脂溶性、原形蓄积和高神经毒等特性。甲基汞进人胃内与胃酸作用，生成氯化甲基汞，95%～100%可经肠道吸收进入血液，在红细胞内与血红蛋白中的疏基结合，随血液分布到脑、肝、肾脏和其他组织。在慢性甲基汞中毒的病程中，各种损害的表现均呈现进行性和不可恢复性（E对ABCD错）。